急性肾小球肾炎与急进性肾小球肾炎临床相似之处为
A. 中度贫血
B. 预后不佳
C. 以急性肾炎综合征起病
D. 肾功能急剧恶化
E. 早期出现急性肾衰竭

正确答案：C。以急性肾炎综合征起病

解析：急性肾小球肾炎与急进性肾小球肾炎临床相似之处为以急性肾炎综合征起病（C对）。中度贫血（A错）、肾功能急剧恶化（D错）、早期出现急性肾衰竭（E错）、预后不佳（B错）为急进性肾小球肾炎的典型特征。